患儿，2岁。发热，体温38℃，鼻塞流涕，咳嗽，皮疹初现，疹色红润，点粒稀疏，躯干为多，多为丘疹，少数疱疹，舌苔薄白，精神尚可。治法是
A. 疏风宣肺止咳
B. 疏风清热解毒
C. 辛凉解表透疹
D. 辛温宣肺透疹
E. 清热凉营解毒

正确答案：B。疏风清热解毒

解析：水痘的皮疹特点为：①初为红斑疹，数小时后变为深红色丘疹，再经数小时发展为疱疹。②皮疹呈向心分布，先出现于躯干和四肢近端，继为头面部、四肢远端，手掌、足底较少。部分患者鼻、咽、口腔、结膜和外阴等处粘膜可发疹，黏膜疹易破，形成溃疡而疼痛。③水痘皮疹先后分批陆续出现，每批历时1～6天，皮疹数目为数个至数百个不等。同一时期常可见斑、丘、疱疹和结痂同时存在。结合患儿发病年龄2岁，皮疹特点为疹色红润，点粒稀疏，躯干为多，多为丘疹，少数疱疹，故可诊断为水痘初起。水痘初期，多以肺卫受邪为主--外感风热时邪，伤及肺卫，故发热，鼻塞流涕，脉浮；风热湿邪透肌表，故可见全身皮肤成批出疹，为红色斑丘疹，少数疱疹，躯干多见。故可辨证为风热湿邪郁于肺卫，当治以疏风清热，解毒利湿（B对）。